诊断神经性厌食时，BMI不高于
A. 17.5kg/m²
B. 22.5kg/m²
C. 15.5kg/m²
D. 18.5kg/m²
E. 25.0kg/m²

正确答案：A。17.5kg/m²

解析：故意限制能量摄入，常为神经性厌食的首发症状。患者主动节食，限制人体必需能量的摄入，导致体重明显低于正常的标准。患者的体重常比正常平均体重减轻15%以上，或者体重指数（BMI）＜17.5（A对），BMI=体重（kg）/身高（m）²。